分子结构中含有苯磺酰胺结构的药物是
A. 唑吡坦
B. 硫喷妥钠
C. 硝西泮
D. 氟西汀
E. 舒必利

正确答案：E。舒必利